下列关于CPI探针检查方法的描述中，不恰当的是
A. 探诊为主，结合视诊
B. 探针与牙长轴平行，紧贴牙根
C. 沿龈沟从远中向近中移动，作上下短距离的颤动
D. 探诊时所用的力不超过30g
E. 探针轻缓地插入龈沟或牙周袋内

正确答案：D。探诊时所用的力不超过30g

解析：CPI探针检查方法以探诊为主，结合视诊。检查时将CPI探针轻缓地插入龈沟或牙周袋内，探针与牙长轴平行，紧贴牙根。沿龈沟从远中向近中移动，作上下短距离的颤动，以感觉龈下牙石。同时查看牙龈出血情况，并根据探针上的刻度观察牙周袋深度。CPI探针使用时所用的力不超过20g，过分用力会引起患者疼痛，有时还会刺破牙龈。掌握“牙周病流行病学及分级预防”知识点。